患儿，男，4岁，因感冒出现鼻塞，可选用的治疗方案是
A. 口服氯苯那敏片
B. 口服头孢呋辛酯片
C. 生理盐水冲洗鼻腔
D. 口服伪麻黄碱缓释片
E. 口服对乙酰氨基酚片

正确答案：C。生理盐水冲洗鼻腔

解析：本题考查感冒用药。治疗儿童感冒症状安全而有效的方法包括生理盐水冲洗鼻腔（C对）、薄荷脑搽剂、蜂蜜（适用于出生后12个月及以上的儿童）。感冒初始阶段所致打喷嚏、流鼻涕选用含抗过敏成分制剂，如盐酸伪麻黄碱（D错），氯苯那敏片（A错）。头孢呋辛酯片（B错）用于敏感细菌引起的上呼吸道感染，下呼吸道感染，泌尿道感染，皮肤和软组织感染及其他感染。对乙酰氨基酚（E错）用于感冒后有微热或流感后出现高热，并伴有明显头痛、关节痛、肌肉痛或全身酸痛。